对考核不合格时医师，县级以上卫生行政部门可以责令其暂停执业活动
A. 1个月至3个月
B. 3个月至6个月
C. 6个月至9个月
D. 1年
E. 2年

正确答案：B。3个月至6个月

解析：对考核不合格时医师，县级以上卫生行政部门可以责令其暂停执业活动3个月至6个月（B对）。